患者56岁，直肠癌，距肛门5cm，未侵出浆膜，经病理检查回报病理类型为腺癌，应选择哪种治疗
A. 拉下式直肠癌切除术
B. 经腹直肠癌切除术
C. 经腹会阴联合直肠癌根治术
D. 保留肛门，直肠癌切除，腹壁造瘘
E. 姑息乙状结肠造瘘术

正确答案：C。经腹会阴联合直肠癌根治术

解析：直肠癌患者，肿瘤距肛门5cm，未侵出浆膜，属于早期，首选手术治疗，且肿瘤距肛缘<7cm，所以应选择经腹会阴联合直肠癌根治术（C对）。拉下式直肠癌切除术（A错）该术式现已较少应用。经腹直肠癌切除术（Dixon手术）适用于肿瘤距肛缘>7cm者（B错）。保留肛门，直肠癌切除，腹壁造瘘（D错）适用于一般情况很差，不能耐受Miles手术或急性梗阻不宜行Dixon手术的病人。姑息乙状结肠造瘘术（E错）适用于晚期直肠癌患者。